心脏病产妇胎儿娩出后应立即
A. 腹部放置沙袋
B. 静注麦角新碱
C. 鼓励下床活动
D. 抗感染
E. 行绝育手术

正确答案：A。腹部放置沙袋

解析：心脏病产妇胎儿娩出后，应立即腹部放置沙袋（A对），以防腹压骤降而诱发心力衰竭；需充分休息并密切监护，不能鼓励下床活动（C错），以加重心脏负担。为防止产后出血过多而加重心肌缺血，加重心力衰竭，可静脉注射或肌内注射缩宫素。静注麦角新碱（B错）用于产后出血的止血，但必须在胎盘娩出后使用，以防子宫强直收缩引起胎盘滞留。对于心脏病产妇产后抗感染（D错）在产程开始后即应进行，直至产后一周左右。不宜再妊娠者可在产后1周行绝育手术（E错）（P87）。